患者，女性，33岁，因左侧上下后牙有自发性疼痛放散至头面部两天来诊检查：左上第一磨牙牙体未见明显异常，疼痛与温度测试无关。牙髓活力测验表现为迟钝，X线片示髓腔内有阻射的钙化物，对该牙进行局部麻醉可缓解疼痛，该牙最可能的诊断为
A. 三叉神经痛
B. 牙髓钙化
C. 牙髓坏死
D. 残髓炎
E. 上颌窦炎

正确答案：B。牙髓钙化

解析：本题考查牙髓钙化的检查。根据题目中的信息牙髓活力测验表现为迟钝，X线片示髓腔内有阻射的钙化物，对该牙进行局部麻醉可缓解疼痛，所以最可能的诊断为牙髓钙化（B对）。X线检查结果作为牙髓钙化的重要诊断依据，且患者无扳机点，无突然发作的阵发性、针刺样、电击样剧烈疼痛，非三叉神经痛（A错）。牙髓坏死牙髓活力测验无反应（C错）。残髓炎对患牙施以强冷或强热刺激进行温度测验，其反应可为迟缓性疼痛或仅诉有感觉（D错）。上颌窦炎可伴有头痛、鼻塞等上呼吸道感染症状，且上颌窦前壁可有压痛表现（E错）。